男，70岁，体检发现肝脏占位1周。既往Hbsag阳性40年，B超发现。肝脏左叶占位，直径8cm，有腹水，血AFP明显增高，肝活检：增生细胞成片状，血窦丰富，细胞体积大，胞浆丰富，核大，核仁明显，核分裂象易见，病理诊断
A. 肝细胞腺瘤
B. 肝细胞癌
C. 胆管细胞癌
D. 海绵状血管瘤
E. 肝硬化

正确答案：B。肝细胞癌

解析：肝细胞癌分化高者癌细胞类似于肝细胞，分泌胆汁，癌细胞排列呈巢状，血管多（似肝血窦）（B对），间质少。胆管细胞癌镜下：癌细胞呈腺管状排列，可分泌黏液，癌组织间质较多。易发生肝外转移，常见部位为肺、骨、脑（C错）。肝海绵状血管瘤常见于中年女性，多为单发，也可多发；左、右肝的发生率大致相等（D错）。肝硬化镜下：①肝小叶结构破坏，被假小叶取代。②假小叶外周被纤维间隔包绕。纤维间隔内有数量不等的炎细胞浸润及小胆管增生（E错）。